胆道完全梗阻时，粪便呈
A. 黄色
B. 黑色
C. 血便
D. 黄褐色
E. 白陶土色

正确答案：E。白陶土色

解析：胆道完全梗阻时，胆红素不能排入肠道形成胆素原和进而形成胆素，因此粪便呈现灰白色或白陶土色。掌握“胆色素代谢”知识点。